男性，20岁。因甲状腺功能亢进症行甲状腺大部分切除术，术后第二天出现手足抽搐。该病人发作性手足抽搐1个月未缓解，且逐渐加重。最有效的治疗方法是
A. 静脉注射10%氯化钾
B. 口服葡萄糖酸钙
C. 口服乳酸钙
D. 口服双氢速甾醇油剂
E. 口服维生素

正确答案：D。口服双氢速甾醇油剂

解析：患者发作性手足抽搐1个月未缓解，且逐渐加重，症状较严重。双氢速甾醇是人体内维生素D3最重要的代谢活性产物之一，能促进肠道对钙的吸收，可有效提高血钙含量。口服双氢速甾醇油剂（D对）后2～3日后始发生作用，一般可维持6～7日，长期使用无耐受性，适用于较严重的病例。静脉注射10%氯化钾（A错）为错误的临床操作，可导致血钾急剧升高，引起心搏骤停。口服葡萄糖酸钙（B错）、口服乳酸钙（C错）、口服维生素D（E错）均为短效制剂，服药频繁（2～3次/天），且疗效相对双氢速甾醇油剂差，一般适用于症状较轻的患者。